发药是中药调剂工作的最后一个环节，执业药师与患者核对药品种类和数量，并对其进行用药指导，关于中成药用药指导内容和要点的说法，正确的有
A. 中成药的使用禁忌和注意事项
B. 需特殊贮存的药品应提醒患者按要求贮存
C. 中西药联用应向患者交代间隔半小时左右服用
D. 中成药的药物组成
E. 栓剂、滴眼液等特殊剂型，应向患者说明正确的使用方法

正确答案：A、B、C、E。中成药的使用禁忌和注意事项；需特殊贮存的药品应提醒患者按要求贮存；中西药联用应向患者交代间隔半小时左右服用；栓剂、滴眼液等特殊剂型，应向患者说明正确的使用方法

解析：本题考查的是中成药用药指导内容与要点。中成药的使用禁忌和注意事项（A对）、需特殊贮存的药品应提醒患者按要求贮存（B对）、中西药联用应向患者交代间隔半小时左右服用（C对）与栓剂、滴眼液等特殊剂型，应向患者说明正确的使用方法（E对）。中成药用药指导内容与要点：（1）与患者核对药品种类和数量（D错），根据处方向患者明确药品的用法用量，如用药时间、用药间隔等。对特殊剂型，如栓剂、滴眼剂、贴膏剂等，需特别说明使用方法。（2）向患者说明中成药的使用禁忌和注意事项。特别是对含罂粟壳、含毒性药味、含朱砂和雄黄、含易引发肝肾损害药味等的中成药，应重点向患者说明药物的功效、使用方法和注意事项。（3）如有联合用药情况，向患者交代联合用药需注意的问题，如中成药和西药，应相隔半小时左右服用。（4）如有需特殊储存的药品，提醒患者按要求储存。（5）对特殊人群，如过敏体质、妊娠妇女等，应详细询问用药史、过敏史等相关信息，避免发生药害事件。（6）如有关于药品疗效、药品质量、不良反应等方面的咨询，应尽可能作答，如不确定，应在事后详查并予以回复。